皮肤扁平苔藓损害主要表现为
A. 网状型
B. 扁平丘疹
C. 环状型
D. 斑块型
E. 条纹型

正确答案：B。扁平丘疹

解析：本题考查皮肤扁平苔藓损害的主要表现。扁平苔藓（OLP）是一种常见口腔黏膜慢性炎症疾病，好发于中年女性，皮肤和黏膜可同时发病，口腔病损为小丘疹连成的线状白色、灰白色花纹，病损大多左右对称，可发生口腔黏膜的任何部位，以颊部最为多见，患者自觉黏膜有粗糙感、木涩感、烧灼感、口干。典型的皮肤病损为扁平的多角形丘疹（B对）。